女性，35岁，颈前区肿块10年，近年来易出汗、心悸，渐感呼吸困难。体检：晨起心率104次/分，BP120/60mmHg，无突眼，甲状腺Ⅲ度肿大，结节状，心电图示：窦性心率不齐。最佳的治疗方法是
A. 内科药物治疗
B. 甲状腺大部切除术
C. 甲状腺全切术
D. 同位素治疗
E. 外放射治疗

正确答案：B。甲状腺大部切除术

解析：甲亢的手术治疗指征包括：①继发性甲亢或高功能腺瘤；②中度以上的原发性甲亢；③腺体较大，伴有压迫症状，或胸骨后甲状腺肿等类型甲亢；④抗甲状腺药物或¹³¹I治疗后复发者或坚持长期用药有困难者。⑤妊娠早、中期的甲亢病人凡具有上述指征者，应考虑手术治疗，并可以不终止妊娠。该患者诊断为结节性甲状腺肿继发甲亢，存在手术治疗指征。最常用术式为甲状腺大部切除术（B对），通常需切除腺体的80%～90%，并同时切除峡部，每侧保留3～4g腺体以维持产生生理剂量的甲状腺素的能力。行甲状腺全切术（C错）将导致永久性甲状腺功能低下，需终生行甲状腺素片替代治疗。甲亢的内科药物治疗（A错）以硫脲类为主，多用于甲状腺轻、中度肿大，而该患者甲状腺重度肿大（Ⅲ度）。此外继发性甲亢应用硫脲类药物治疗后长期缓解率很低，一般只作为术前辅助用药。同位素治疗（D错）为美国治疗甲亢的首选方法，但在我国一般不作为首选。外放射治疗（E错）在甲状腺一般用于治疗未分化型甲状腺癌。